“胃之关”指的是
A. 大肠
B. 肾
C. 幽门
D. 贲门
E. 阑门

正确答案：B。肾

解析：肾主水是指肾具有主持和调节人体水液代谢的功能，主要体现在以下两个方面：①调节并参与津夜代谢相关脏腑功能：肾为脏腑之本，肾气的蒸腾气化、肾阴的滋润宁静、肾阳的温煦推动，对各脏腑参与津液代谢功能的正常发挥具有重要的调控作用。通过对各脏腑之气及其阴阳的调控，肾主司和调节着机体津液代谢的各个环节。肾的调控作用失常，或为津液生成不足，或为津液输布和排泄障碍。《素问·水热穴论》说“肾者，胃之关也（B对），关门不利，故聚水而从其类也，上下溢于皮肤，故为附肿。附肿者，聚水而生病也。”。②调节尿液的生成和排泄。大肠为"传导之官"，主传导糟粕（A错）；在《难经·四十四难》中，对“七冲门”的位置及功能进行了描述，其中胃为贲门（D错）、太仓下口为幽门（C错）、大肠小肠会为阑门（E错）。